需要进行终末消毒的传染病是
A. 麻疹
B. 伤寒
C. 水痘
D. 流感

正确答案：B。伤寒

解析：本题考查需要进行终末消毒的传染病。终末消毒是当传染源痊愈、死亡或离开后对疫源地进行的彻底消毒，从而清除传染源所播散在外界环境中的病原体。对外界抵抗力较强的病原体引起的传染病才需要进行终末消毒，如鼠疫、霍乱、病毒性肝炎、结核、伤寒（B对）、炭疽、白喉等，而流感（D错）、水痘（C错）、麻疹（A错）等疾病一般不需要进行终末消毒。